属于肠溶性高分子缓释材料的是
A. 羟苯乙酯
B. 明胶
C. 乙烯-醋酸乙烯共聚物
D. β-环糊精
E. 醋酸纤维素酞酸酯

正确答案：E。醋酸纤维素酞酸酯

解析：本题考查脂溶性高分子缓释材料。固体分散物的肠溶性载体材料包括纤维素类和聚丙烯酸树脂类。纤维素类常见的肠溶性纤维素，如醋酸纤维素酞酸酯（CAP）（E对）、羟丙甲纤维素酞酸酯（HPMCP）、羧甲乙纤维素（CMEC）等。聚丙烯酸树脂类常见的有国产的Ⅱ号和Ⅲ号丙烯酸树脂（相当于国外商品名Eudragit L和Eudragit S型）等肠溶性材料。羟苯乙酯（A错）是液体制剂中常用的防腐剂。明胶（B错）是液体制剂常用的增稠剂。乙烯-醋酸乙烯共聚物（C错）为不溶性骨架材料。β-环糊精（D错）为制备包合物的包合材料。